影响中药质量变异的环境因素有
A. 湿度
B. 温度
C. 日光
D. 空气
E. 害虫

正确答案：A、B、C、D、E。湿度；温度；日光；空气；害虫

解析：本题考查的是影响中药质量变异的环境因素。影响中药质量变异的环境因素有湿度（A对）、温度（B对）、日光（C对）、空气（D对）与害虫（E对）。除了自身因素会影响中药质量外，药材、饮片、中成药在贮藏过程中，由于受到外界诸多因素的影响，其质量也会不断发生变化。这些外界因素主要有温度、湿度、空气、日光、微生物（霉菌）及害虫等。另外包装容器、保存时间也是影响中成药质量的重要因素。这些因素直接或间接影响药物，使之产生复杂的物理、化学和生物化学的变化。